下列对半牙切除术的正确解释是
A. 若某一根病变已严重，另一根尚好，则可行半牙切除术，将严重的一半连冠带根一起摘除，保留另一半侧
B. 下颌磨牙当根分叉区病变较重而近、远中根分别还有一定的支持组织时，可行半牙切除术，将患牙分割为近中和远中两个“单根牙”，然后分别做冠或做连冠修复
C. 若多根牙仅有一个根病变较重，有深牙周袋和骨吸收，另一或两个根病情较轻，且患牙尚不太松动，可行半牙切除术
D. 对于骨质破坏较多，牙龈有退缩，术后难以完全覆盖分叉区者，可行半牙切除术
E. 对骨质破坏较轻，根柱较长，牙龈能充分覆盖根分叉开口处的下颌磨牙Ⅱ度病变，可行半牙切除术

正确答案：A。若某一根病变已严重，另一根尚好，则可行半牙切除术，将严重的一半连冠带根一起摘除，保留另一半侧

解析：若某一根病变已严重，另一根尚好，则可行半牙切除术，将严重的一半连冠带根一起摘除，保留另一半侧。掌握“根分叉病变”知识点。